牙体外层被釉质覆盖的部分称为牙冠，也称为
A. 临床牙冠
B. 解剖牙冠
C. 牙根
D. 牙颈
E. 釉牙骨质界

正确答案：B。解剖牙冠

解析：牙体外层被釉质覆盖的部分成为牙冠，也称为解剖牙冠。掌握“牙的组成、分类、功能及牙位记录”知识点。